地方性甲状腺肿的家庭聚集性目前已较肯定主要是由于
A. 接触传播
B. 相似的生活条件或行为习惯
C. 遗传因素
D. 地理环境条件
E. 宗教信仰、文化教育等精神、社会因素

正确答案：D。地理环境条件

解析：本题考查地方性甲状腺肿的家族聚集性。地方性甲状腺肿的家族聚集性主要是由于疾病与自然环境中的微量元素分布有关，受地理环境条件（D对ABCE错）影响。